3个月龄婴儿的头围约是
A. 36cm
B. 40cm
C. 46cm
D. 50cm
E. 56cm

正确答案：B。40cm

解析：婴儿出生时头围平均33～34cm，第1年前3个月头围的增长（6cm）约等于后9个月头围的增长值（6cm），因此3个月时头围应是34cm＋6cm＝40cm（B对）。